医学心理学包括的医学类型是
A. 心理范围 文化范围 社会范围
B. 心理范围 文化范围 病理范围
C. 文化范围 社会范围 病理范围
D. 心理范围 社会范围 医学范围
E. 病理范围 文化范围 心理范围

正确答案：D。心理范围 社会范围 医学范围

解析：医学心理学的医学类型包括心理范围、社会范围、医学范围（D对）。